可致水质发黑、发臭的是
A. 耗氧作用＞复氧作用
B. 耗氧作用＜复氧作用
C. 耗氧作用＝复氧作用
D. 氧垂曲线溶解氧的最低点＞4mg/L
E. 氧垂曲线溶解氧的最低点＜4mg/L

正确答案：E。氧垂曲线溶解氧的最低点＜4mg/L

解析：本题考查生物净化的相关内容。若Cp点溶解氧含量大于地表水卫生标准规定的数值（4mg/L），表明废水中耗氧有机物的排放未超过水体的自净能力；若排入的有机物过多，超过河流的自净能力，则Cp点低于卫生标准规定的最低溶解氧含量（E对ABCD错），甚至在排放点下游的某一河段会出现无氧状态，此时水中厌氧菌对有机物进行厌氧分解，产生硫化氢、甲烷等，水质严重恶化、变黑发臭。